十二经脉中，循行于下肢外侧后缘的是
A. 足少阳胆经
B. 足阳明胃经
C. 足少阴肾经
D. 足太阳膀胱经
E. 足太阴脾经

正确答案：D。足太阳膀胱经

解析：本题考查的是十二经脉在四肢的分布规律。十二经脉中，循行于下肢外侧后缘的是足太阳膀胱经（D对）。十二经脉在四肢的分布规律：阴经分布于内侧面，阳经分布于外侧面。内侧分为三阴，外侧分为三阳，前后顺序规律：太阴、阳明在前缘，少阴、太阳在后缘，厥阴、少阳在中线。上肢内侧的经脉分布是手太阴肺经在前，手厥阴心包经在中，手少阴心经在后；上肢外侧的经脉分布是手阳明大肠经在前，手少阳三焦经在中，手太阳小肠经在后。下肢内侧的经脉分布是内踝上八寸以下，足厥阴肝经在前，足太阴脾经在中，足少阴肾经在后；至内踝八寸以上，则足太阴脾经（E错）在前，足厥阴肝经在中，足少阴肾经（C错）在后；下肢外侧的经脉分布是，足阳明胃经（B错）在前，足少阳胆经（A错）在中，足太阳膀胱经在后。